需要是指
A. 对某种目标的渴求和欲望
B. 对有机体内部不平衡状态的反映，表现为有机体对内环境条件的欲求
C. 对有机体外部不平衡状态的反映，表现为有机体对外环境条件的欲求
D. 对有机体外部不平衡状态的反映，表现为有机体对内外环境条件的欲求
E. 对有机体外部不平衡状态的反映，表现为有机体对环境的欲求

正确答案：A。对某种目标的渴求和欲望